感光细胞是
A. 视神经盘
B. 视网膜的视锥细胞和视杆细胞
C. 视网膜的双极细胞
D. 黄斑
E. 视网膜节细胞

正确答案：B。视网膜的视锥细胞和视杆细胞

解析：感光细胞是视网膜的视锥细胞和视杆细胞（B对）。视网膜的双极细胞（C错）负责传递神经冲动给节细胞，并非感光细胞；视网膜的节细胞（E错）构成视神经，也非感光细胞。